临床心血管治疗药物检测中，某药物浓度与靶器官中药物浓度相关性最大的生物样本是
A. 血浆
B. 唾液
C. 尿液
D. 汗液
E. 胆汁

正确答案：A。血浆

解析：本题考查体内药物检测。临床心血管治疗药物检测中，某药物浓度与靶器官中药物浓度相关性最大的生物样本是血浆（A对）。血药浓度系指药物吸收后在血浆内的总浓度，包括与血浆蛋白结合的或在血浆游离的药物，与给药剂量、给药途径(口服、舌下、吸入、注射)、给药次数以及时间有关。血浆中药物的浓度能够反映药物在靶器官的状况。唾液（B错）不一定与药物浓度有相关性，取决于药物使用部位。尿液（C错）中的药物浓度变化较大。汗液（D错）、胆汁（E错）不属于药物监测标本。